男，33岁，15年前曾发现蛋白尿，一直未检查和治疗。三周前出现恶心呕吐，查：血压190/120mmHg，轻度浮肿，血肌酐360μmol/L，B超双肾缩小。该患者最可能的原发病是
A. 慢性肾小球肾炎
B. 慢性肾盂肾炎
C. 慢性间质性肾炎
D. 糖尿病肾病
E. 高血压肾病

正确答案：A。慢性肾小球肾炎

解析：该患者初步诊断为慢性肾衰竭，最可能的原发病是慢性肾小球肾炎（A对）。慢性肾小球肾炎以中青年男性多见，多数起病缓慢，早期可无任何症状，实验室检查多为轻度尿异常，尿蛋白常在1～3g/d之间，肾功能正常或轻度受损（血肌酐升高），这种情况可持续数年，甚至数十年，肾功能逐渐恶化并出现相应的临床表现（如贫血、血压增高等），最后进入终末期肾衰竭。慢性肾盂肾炎（P493）（B错）多有反复发作的泌尿系统感染史，并有影像学及肾功能异常，尿沉渣中常有白细胞，尿细菌学检查阳性。慢性间质性肾炎（P490）（C错）首先出现肾小管功能损害，表现为夜尿多、低比重及低渗透压尿、肾小管酸中毒等，晚期损伤累及肾小球时才出现蛋白尿、水肿和高血压等肾炎综合征，直至进入终末期肾病，出现慢性肾衰竭的症状。糖尿病肾病（P482）（D错）是在确诊为糖尿病的基础上伴发的肾脏损害。高血压肾病（P250）（E错）是在长期持续高血压后引起的慢性肾衰竭的表现。